猩红热的主要病机是
A. 痧毒疫疠蕴于肺胃
B. 麻疹热毒犯于肺卫
C. 麻疹热毒蕴于脾胃
D. 痧毒疫疠侵犯肝胆
E. 以上都不是

正确答案：A。痧毒疫疠蕴于肺胃

解析：猩红热的中医病因病机：病之初起，首犯肺卫，邪郁肌表，正邪相争，可见恶寒发热等肺卫表证。继而痧毒疫疠之邪化火入里，蕴于肺胃。咽喉为肺胃之门户，咽通于胃，喉通于肺，肺胃热盛，熏蒸咽喉，则咽喉糜烂、红肿疼痛；热毒灼伤肌膜，导致咽喉溃烂白腐；肺主皮毛，胃主肌肉，痧毒之邪，内蕴肺胃，外泄肌表，则肌肤透发痧疹，色如红丹。邪毒进一步化火如里，传入气营，或内迫营血则可见壮热烦渴，皮疹如丹，成片成斑；舌为心之苗，邪毒内盛，心火独盛，加之热耗津液，故舌生红刺，舌光无苔，状如杨梅。若邪毒炽盛，内陷心肝，则可出现神昏抽搐。邪从火化，最易伤阴耗液，故病之后期可见肺胃阴伤之证（A对）。